重度失血患者失代偿时，可出现的临床表现是
A. 动脉血压升高，尿量减少
B. 动脉血压降低，尿量减少
C. 动脉血压升高，尿量增加
D. 动脉血压降低，尿量增加
E. 动脉血压和尿量无明显变化

正确答案：B。动脉血压降低，尿量减少

解析：重度失血患者失代偿期，属于重度休克，由于有效血容量不足，则表现为动脉血压降低。动脉血压下降，导致肾有效灌注压减少，则表现为尿量减少（B对）。